治疗风痫的首选方剂是
A. 温胆汤
B. 涤痰汤
C. 指迷茯苓丸
D. 定痫丸
E. 黄连温胆汤

正确答案：D。定痫丸

解析：本证多由惊风反复发作，风邪与伏痰相搏，进而阻塞心窍，扰乱神明，横窜经络，因而时发时止，形成癫痫。即所谓"惊风三发便成痫"。三发是指惊风多次发作不愈，迁延可致癫痫。临床以发作时肢体抽搐明显，常伴有神志不清，口吐白沫，口唇色青为特征，宜用具有息风定痫功效的定痫丸（D对）；温胆汤具有理气化痰，和胃利胆之功效，主治胆郁痰扰证，症见胆怯易惊，头眩心悸，心烦不眠，夜多异梦；或呕恶呃逆，眩晕，癫痫。苔白腻，脉弦滑（A错）；涤痰汤具有涤痰开窍功效，用于治疗痰痫，症见发作时痰涎壅盛，喉间痰鸣，神志恍惚，状如痴呆，或为失神，瞪目直视，或仆倒于地，手足抽搐不甚明显，肢体麻木、疼痛，骤发骤止，舌苔白腻，脉滑（B错）；指迷茯苓丸具有燥湿和中、化痰通络的功效，用于治疗痰饮停滞中脘所致的疼痛。缓解两臂酸痛或抽掣，不能上举，疼痛左右转移，两手发麻，四肢浮肿等症状（C错）；黄连温胆汤具有泄火涤痰，清心安神的功效，用于治疗抽动障碍中的痰火扰心证，症见头面、躯干、四肢肌肉抽动，频繁有力，喉中痰鸣，怪声不断，或口出异声秽语，烦躁口渴，睡眠不安，便秘溲赤，舌质红，苔黄腻，脉滑数（E错）。